能形成芽胞的细菌为
A. 军团菌
B. 铜绿假单胞菌
C. 炭疽杆菌
D. 大肠杆菌
E. 布氏杆菌

正确答案：C。炭疽杆菌